人体内合成尿素的主要脏器是
A. 脑
B. 肌肉
C. 肾
D. 肝
E. 心

正确答案：D。肝

解析：人体内合成尿素的主要脏器是肝（D对），在肝中通过鸟苷酸循环由氨合成尿素，在氨解毒中发挥重要的作用。